关于生物等效性研究的实施与样品采集的说法正确的是
A. 通常采用受试制剂和参比制剂的单个最低规格制剂进行试验
B. 从0时到最后一个样品采集时间的AUC与时间从0到无穷大的AUC之比通常应当大于70%
C. 整个采样时间不少于3个末端消除半衰期
D. 受试制剂与参比制剂药物含量的差值应小于2%
E. 一般情况下，受试者试验前至少空腹8小时

正确答案：C。整个采样时间不少于3个末端消除半衰期

解析：本题考查生物等效性研究的实施与样品采集。整个采样时间不少于3个末端消除半衰期（C对）；空腹试验，试验前夜至少空腹10小时（E错）；通常最高规格的制剂（A错）可以一个单位（单片或单粒）服用，如生物样品分析方法灵敏度不足，则可在安全性允许的条件下，在说明书单次服药剂量范围内同时服用多片粒最高规格制剂；受试制剂与参比制剂药物含量的差值小于5%（D错）；从0时到最后一个样品采集时间t的曲线下面积与时间从0到无穷大的AUC之比通常应当大于80%（B错）。